指导合作型的特点是
A. 医患双方不是双向作用，而是医生对病人单向发生作用
B. 医患双方在医疗活动中都是主动的，医生有权威性，充当指导者
C. 医生和病人具有近似同等的权利
D. 长期慢性病人已具有一定医学科学知识水平
E. 急性病人或虽病情较重但他们头脑是清醒的

正确答案：B。医患双方在医疗活动中都是主动的，医生有权威性，充当指导者

解析：指导合作型的特点是医患双方在医疗活动中都是主动的，医生有权威性，充当指导者。患者被看作有意识、有思想的人，具有一定的主动性，能够主动述说病情，反映诊治情况，配合检查和治疗。医者仍具有权威性，仍居于主导地位（B对）。